之所以可以采用固定桥修复牙列缺损是由于
A. 患者比较舒适
B. 满足患者的美观要求
C. 牙周有储备力
D. 可以恢复缺失牙形态
E. 可以恢复咀嚼功能

正确答案：C。牙周有储备力

解析：牙周储备力又被称为牙周潜力，是指在正常咀嚼运动中，咀嚼食物的（牙合）力大约只为牙周组织所能支持的力量的一半，而在牙周组织中尚储存的另一半的支持能力。固定桥修复中正是动用了基牙的部分甚至全部牙周储备力，以承担桥体的额外负担来补偿缺失牙的功能。掌握“固定桥的适应证与禁忌证”知识点。